在常用的问卷调查实施中，分发问卷法、集合法、邮寄法与面访法比较的优点是
A. 可以控制答卷环境
B. 可以使用较为复杂的调查表
C. 几乎不存在调查员个人素质的影响，漏填和不合理回答的发生率低
D. 节约经费和时间
E. 具有一定的灵活性

正确答案：D。节约经费和时间